抑制性突触后电位产生的离子机制是
A. Na⁺内流
B. K⁺内流
C. Ca²⁺内流
D. Cl⁻内流
E. K⁺外流

正确答案：D。Cl⁻内流